与女子妊娠关系密切，主胞胎的是
A. 督脉
B. 任脉
C. 冲脉
D. 带脉
E. 维脉

正确答案：B。任脉

解析：督脉的生理功能：1.调节阳经气血，为“阳脉之海”，2.反映脑、髓和肾的功能（A错）。任脉的生理功能：1.调节阴经气血，为“阴脉之海”，2.任主胞胎，任脉起于胞中，与女子月经来潮及妊养、生殖功能有关（B对）。冲脉的生理功能:1.调节十二经脉气血,2.与女子月经及生殖功能有关(C错)。带脉的生理功能：1.约束纵行诸经，2.主司妇女带下（D错）。维脉的生理功能：阴维脉“维络诸阴”，阳维脉“维络诸阳”，阴阳相辅，对诸阴阳经脉气血起着溢蓄调节作用（E错）。